常用的界定值鼻呼吸比例为多少时，认为是口呼吸
A. 比例≤20%或≤25%
B. 比例≤30%或≤35%
C. 比例≤60%或≤55%
D. 比例≤70%或≤75%
E. 比例≤90%或≤95%

正确答案：D。比例≤70%或≤75%

解析：所谓口呼吸是指呼吸时口鼻并用，完全口呼吸者很少。各研究所用的界定值有所不同，常用的界定值为鼻呼吸比例≤70%或≤75%时，则认为口呼吸。掌握“吞咽、呼吸及言语”知识点。